下列除哪项外均可出现蛋白尿
A. 高热
B. 高血压
C. 妊娠
D. 心功能不全
E. 慢性胃炎

正确答案：E。慢性胃炎

解析：生理性蛋白尿常见于精神激动、剧烈运动、妊娠（C对）、高热（A对）、交感神经兴奋及血管活性剂等，都可能出现暂性的蛋白尿。病理性蛋白尿常见有肾小球性蛋白尿如急性肾炎、慢性肾炎、肾病综合征，糖尿病、高血压（B对）、系统性红斑狼疮、妊娠高血压综合征等继发性肾小球损害性；心功能不全时（D对）肾静脉瘀血会出现尿蛋白。慢性胃炎（E错，为本题正确答案）不会引起尿蛋白。